两种或两种以上化学毒物作用于机体表现出独立作用，主要是由于
A. 化学毒物各自作用的受体、靶不同，出现各自不同的毒效应
B. 化学毒物在化学结构上为同系物
C. 化学毒物毒作用的靶器官相同
D. 化学毒物在对机体毒作用方面存在竞争作用

正确答案：A。化学毒物各自作用的受体、靶不同，出现各自不同的毒效应

解析：本题考查独立作用。两种或两种以上化学毒物作用于机体表现出独立作用，主要是由于化学毒物各自作用的受体、靶不同，出现各自不同的毒效应（A对BCD错）。